选项中能体现医生遵守不伤害原则的是
A. 同情患者
B. 对待患者一视同仁
C. 保守患者的秘密和隐私
D. 选择对患者、对社会均有利的医疗卫生保健措施
E. 在诊治活动中杜绝有意和责任性伤害

正确答案：E。在诊治活动中杜绝有意和责任性伤害

解析：在医学实践中，不伤害是指在诊治、护理过程中不使患者的身心受到损害。但是不伤害不是绝对的。因此在诊治活动中杜绝有意和责任性伤害体现了不伤害原则。掌握“医学伦理的基本原则”知识点。